欧美医学伦理学（生命伦理学）四原则不包含
A. 不伤害
B. 有利
C. 尊重
D. 胆识
E. 公正

正确答案：D。胆识